某女，27岁。口腔黏膜溃疡，周边充血发红，疼痛，伴口干渴，口臭便秘，尿黄；舌红苔黄，脉数有力。诊断为口疮，宜选用的中成药是
A. 牛黄清胃丸
B. 牛黄化毒片
C. 银翘解毒丸
D. 羚羊清肺颗粒
E. 芎菊上清片

正确答案：A。牛黄清胃丸

解析：本题考查口疮之心脾积热证的中成药应用。诊断为口疮，宜选用的中成药是牛黄清胃丸（A对）。口疮之心脾积热证【症状】口腔黏膜溃疡，灼痛明显，常因过食煎炒辛辣或少寐而发，伴口渴心烦、失眠、小溲短黄、大便秘结；检查见口腔黏膜表面有黄白色假膜，周边红肿。舌红，苔黄或腻，脉数有力。【中成药应用】常用中成药为牛黄清胃丸、导赤丸。乳痈之热毒炽盛证【症状】乳房肿痛加剧，皮肤焮红灼热，继之肿块变软，有应指感；或溃后脓出不畅，红肿热痛不消，有“传囊”现象；伴壮热不退，口渴喜饮，便秘溲赤。舌质红，苔黄腻，脉洪数。【中成药应用】常用中成药为牛黄化毒片（B错）、九一散。感冒之风热感冒【症状】身热较著，微恶风，头胀痛，或咳嗽少痰，或痰出不爽，咽痛咽红，口渴。舌边尖红，苔薄白或微黄，脉浮数。【中成药应用】常用中成药为银翘解毒丸（C错）、双黄连口服液、桑菊感冒片、感冒清胶囊、柴银口服液。咳嗽之风热犯肺证【症状】咳嗽频剧，气粗，或咳声嗄哑，咳痰不爽，痰黏稠或稠黄，喉燥咽痛，口渴，鼻流黄涕，头痛，肢楚，恶风身热。舌边尖红，苔薄黄，脉浮数。【中成药应用】常用中成药为桑菊感冒片、急支糖浆、羚羊清肺颗粒（D错）、风热咳嗽胶囊。头痛之风热头痛【症状】头痛而胀，甚则头痛如裂，发热或恶风，口渴欲饮，面红目赤，或便秘溲黄。舌尖红，苔黄，脉浮数。【中成药应用】常用中成药为清眩片、芎菊上清片（E错）。